依据气能生血理论确立的治疗方法是
A. 治疗血虚常配用补气药
B. 治疗津虚常配用补气药
C. 治疗出血常配用补气药
D. 治疗血瘀常配用补气，行气药
E. 治疗痰饮常配用补气，行气药

正确答案：A。治疗血虚常配用补气药

解析：血液的化生以营气、津液和肾精作为物质基础，在这些物质本身的生成以及转化为血液的过程中，每一个环节都离不开相应脏腑之气的推动和激发作用，这是血液生成的动力。气能生血还包含了营气在血液生成中的作用，营气与津液入脉化血，使血最充足。气充盛则化生血液的功能增强，血液充足，因此在治疗血虚时常常配伍补气药（A对）。